婴幼儿腹泻，服用地衣芽孢杆菌活菌制剂，正确的使用方法是
A. 清晨服用
B. 用温水调服
C. 应同时碱化尿液
D. 舌下含服
E. 睡前服用

正确答案：B。用温水调服

解析：本题考查药品的正确使用。服用地衣芽孢杆菌活菌制剂应用温水调服（B对）。含活性菌类药物如乳酶生、整肠生等，该类药物遇热会引起活性菌被破坏，因此不能用热水送服。呋塞米、螺内酯为利尿药，宜于清晨服用（A错）。宜睡前服用（E错）的药物有催眠药、平喘药、调节血脂药、抗过敏药、钙剂。硝酸甘油片，舌下含服（D错），用于稳定型心绞痛。苯溴马隆服用时应多饮水，同时应碱化尿液（C错），以防止形成尿酸结石。